黄曲霉毒素B1的靶器官主要是
A. 脾
B. 肝
C. 心
D. 肺
E. 脑

正确答案：B。肝

解析：黄曲霉菌广泛存在于霉变食品中。霉变的花生、玉米及谷类含量最多。黄曲霉毒素有多种，其中黄曲霉毒素B1致癌性最强。黄曲霉毒素B1是异环芳烃，在肝脏代谢为环氧化物，可使肿瘤抑制基因p53发生点突变而失去活性。这种毒素可诱发肝细胞癌。乙型肝炎病毒（HBV）感染导致肝细胞慢性损伤和再生，可能给黄曲霉毒素B1的致突变作用提供了条件。HBV感染与黄曲霉毒素B1的协同作用可能是我国肝癌高发地区的重要致肝癌因素。因此黄曲霉毒素B1的靶器官主要是肝（B对）。